女，25岁，近半年来反复担心自己会拿刀具伤人，害怕自己会拿锋利的菜刀伤害家人，自己知道这些想法不合理，努力控制不去想，但非常痛苦，该患者最可能的诊断是
A. 抽动障碍
B. 强迫障碍
C. 精神分裂症
D. 恐惧性焦虑障碍
E. 广泛性焦虑障碍

正确答案：B。强迫障碍

解析：患者青年女性，反复担心自己伤害他人（强迫观念），知道这些想法不合理，努力控制不去想，但非常痛苦（强迫症的典型表现）。因此最可能的诊断是强迫障碍（B对）。抽动障碍（A错）发病与18岁前，指患者不能自控的头面部、四肢等快速、短暂、不规则抽动，也可伴不自主发声抽动（P237）。